下列选项中属于美国社会健康协会指标计算公式中分子的是
A. 成人识字率×就业率×人均国民生产总值增长率×平均期望寿命
B. 出生率×婴儿死亡率×就业率×平均期望寿命
C. 成人识字率×出生率×就业率×平均期望寿命
D. 婴儿死亡率标准值×1岁平均期望寿命标准值×识字率标准值
E. 成人识字率×就业率×人均国民生产总值×平均期望寿命

正确答案：A。成人识字率×就业率×人均国民生产总值增长率×平均期望寿命

解析：本题考查美国社会健康协会指标计算公式。美国社会健康协会指标计算公式中的分子是：成人识字率×就业率×人均国民生产总值增长率×平均期望寿命（A对BCDE错）。